马钱子中的生物碱主要是
A. 吲哚类
B. 异喹啉类
C. 莨菪烷类
D. 喹喏里西啶类
E. 有机胺类

正确答案：A。吲哚类